咬肌与颊肌之间存在的一个狭小的筋膜间隙，颊脂垫正位于其中，此间隙亦称为
A. 颞间隙
B. 眶下间隙
C. 下颌下间隙
D. 颊间隙
E. 颞下间隙

正确答案：D。颊间隙

解析：本题考查面部筋膜间隙。颊间隙（D对）是咬肌与颊肌之间存在的一个狭小的筋膜间隙，颊脂垫正位于其中。眶下间隙（B错）位于面部前方，界眶下缘，下界上颌骨牙槽突，内侧界鼻侧缘，外侧界颧大肌。颞间隙（A错）位于颞区，借颧弓和颞下嵴的平面与颞下间隙分界，颞间隙可分为颞浅间隙和颞深间隙。颞下间隙（E错）位于颞下区，前界上颌骨的后面；后界腮腺深叶；内界蝶骨翼突外侧板、部分翼内肌及咽侧壁；外界下颌支上份及颧弓，上界为蝶骨大翼的颞下面和颞下嵴，下以翼外肌下缘平面为界。下颌下间隙（C错）主要位于下颌下三角内，由颈筋膜浅层在下颌下腺处分为浅、深两层，浅、深两层向上分别附丽于下颌骨下缘和内斜线。